舌绛少苔有裂纹，多见于
A. 热邪内盛
B. 气血两虚
C. 阴虚火旺
D. 瘀血内阻
E. 脾虚湿侵

正确答案：C。阴虚火旺

解析：舌绛少苔或无苔，或有裂纹，多属久病阴虚火旺，或热病后期阴液耗损（C对）。热邪内盛可见舌质有苔，多属温热病热入营血，或脏腑内热炽盛（A错）。气血两虚的舌质为淡白舌，舌色淡白光莹，或舌体瘦薄（B错）。瘀血内阻的舌质为青舌，舌边青者，或口燥而漱水不欲咽（D错）。脾虚湿侵可见舌淡胖苔白滑，多由脾肾阳虚，水湿内停所致（E错）。